在常用的几种抽样方法中，最便于组织且节省经费的是
A. 单纯随机抽样
B. 分层抽样
C. 整群抽样
D. 机械抽样
E. 单纯随机抽样和机械抽样

正确答案：C。整群抽样